下列属于天麻功效的是
A. 息风定惊，清热平肝，定惊止搐
B. 息风止痉，平抑肝阳，祛风通络
C. 发表透疹，清热解毒，升举阳气
D. 息风止痉，通络止痛，攻毒散结
E. 清热定惊，通络平喘，利尿

正确答案：B。息风止痉，平抑肝阳，祛风通络

解析：天麻味甘，性平，入肝经，善平肝阳，息肝风、定惊抽。因性质平和，无燥烈伤阴之弊，被称为用治肝风惊抽要药。为风药中之润剂。且具有祛外风通经络作用（B对）。